具有同质多晶性、过热易使其熔点下降而不易成型的栓剂基质是
A. 可可豆脂
B. 半合成山苍子油酯
C. 半合成椰子油酯
D. 单硬脂酸甘油酯
E. 聚乙二醇

正确答案：A。可可豆脂